马尾位于
A. 硬膜外隙
B. 蛛网膜下隙
C. 终池
D. 乙状窦
E. 硬膜下隙

正确答案：C。终池

解析：马尾位于脊髓下端至第2骶椎之间扩大的蛛网膜下隙即终池（C对）内，由腰、骶、尾部脊神经根围绕终丝形成。